三级空气质量指数所对应的类别及颜色分别是
A. 良黄色
B. 轻度污染黄色
C. 轻度污染橙色
D. 中度污染橙色
E. 中度污染白色

正确答案：C。轻度污染橙色